患儿，3岁。出丹痧后，眼睑浮肿继而全身浮肿，按之凹陷随手而起尿少。其病机是
A. 肺脾气虚，水湿不化
B. 耗伤肾阳，气不化水
C. 湿热内蕴，下焦不利
D. 冒受外风，肺失宣降
E. 余邪未清，内归肺脾

正确答案：E。余邪未清，内归肺脾

解析：患儿出丹痧后出现全身的非凹陷性水肿及少尿，当属急性肾小球肾炎，缘患儿丹痧余毒未清与水湿互结，通调、运化、开阖失司，水液代谢障碍而发为肿，故可见眼睑浮肿继而全身浮肿，按之凹陷随手而起，尿少（E对）。患儿无肺脾气虚之象，出现水肿源于余毒困于肺脾（A错）。未见形寒肢冷，大便溏薄等症，无肾阳虚衰之象（B错）。丹痧之毒非湿热之邪（C错）。患儿丹痧已出，已非外邪侵袭之初期，病位已不仅在肺（D错）。